患者男，78岁，实施右侧髋关节置换术，术后第10日，患侧下肢出现肿胀、疼痛，诊断为深静脉血栓。该患者应选用的药物是
A. 阿司匹林
B. 血凝酶
C. 氯吡格雷
D. 依诺肝素
E. 替格瑞洛

正确答案：D。依诺肝素

解析：本题考查依诺肝素。该患者应选用的药物是依诺肝素（D对）。深静脉血栓形成是指血液在深静脉内不正常凝结引起的病症，多发生于下肢，血栓脱落可引起肺栓塞，可选用依诺肝素进行抗凝治疗。阿司匹林（A错）对缓解轻度或中度疼痛，如牙痛、头痛、神经痛及痛经效果较好，亦用于感冒、流感等发热疾病的退热等。血凝酶（B错）可用于需减少流血或止血的各种医疗情况。氯吡格雷（C错）用于预防和治疗因血小板高聚集引起的心、脑及其它动脉循环障碍疾病。替格瑞洛（E错）用于急性冠脉综合征患者。